女性，19岁，学生。近1年来经常脑内反复思考问题，如做数学题时，反复核对答案，明知不对，但又无法控制，最可能的诊断是
A. 神经衰弱
B. 焦虑症
C. 癔症
D. 强迫症
E. 精神分裂症

正确答案：D。强迫症

解析：该病例患者为青少年女性（20～24岁的女性好发），近一年来（连续两周以上），脑中反复出现一些没有必要的相同内容的数学题，患者明知没有必要，但是无法控制（强迫思维），故最可能的诊断是强迫症（D对）。焦虑症和强迫症均有焦虑表现，但焦虑症无焦虑对象（B错），强迫症患者的强迫观念和行为常起源于患者的主观体验。精神分裂症可出现强迫症状，但患者往往不为之苦恼，无主动克制或摆脱的愿望，无治疗要求，且本例患者未出现精神分裂症的阴性（意志减退）或阳性症状（幻觉、妄想）（E错）。